皮肤结节性红斑，疱疹性结膜炎，多发性一过性关节炎，颈淋巴结肿大，常见于
A. 风湿热
B. 传染性单核细胞增多症
C. 类风湿热
D. 原发性肺结核
E. 川崎病

正确答案：D。原发性肺结核

解析：风湿热（P154）（A错）在发病前1～4周有上呼吸道感染史，关节炎以游走性和多发性为特点，环形红斑、结节性或多形性红斑见于近5%的风湿热患者，以环形红斑最常见。传染性单核细胞增多症（P176）（B错）发热，颈淋巴结肿大咽痛，肝脾肿大，多形性皮疹，神经系统症状见于少数严重的病例。类风湿热（C错）多见于20-45岁女性，好发于小关节，且很难不留畸形。原发性肺结核（P192）（D对）1.初起时可有低热、轻咳、食欲减退等，常常容易被诊为感冒或支气管炎而被忽视，稍重者结常有全身淋巴结肿大；2. 结核过敏症状 可出现皮肤结节性红斑、疱疹性结膜炎及结核性风湿病（一过性多发性关节炎）。 3. 呼吸系症状 多为一声声干咳，淋巴结肿大压迫支气管者，可呈百日咳似的痉挛性咳嗽，咯血较成人少见；肺部阳性体征少于肺部X线病变。川崎病（P164）（E错）主要表现：发热，球结合膜充血，唇充血皲裂，草莓舌，手足硬性水肿，多形性皮斑和猩红热样皮疹，颈部淋巴结肿大。